下列何种疾病在流行时可对接触者进行应急接种
A. 白喉
B. 流感
C. 乙型肝炎
D. 百日咳
E. 菌痢

正确答案：A。白喉

解析：本题考查应急接种。应急接种是在传染病流行开始或有流行趋势时，为控制疫情蔓延，对易感人群开展的预防接种活动。白喉（A对BCDE错）在流行时可对接触者进行应急接种。